腭帆至咽侧壁的粘膜皱壁
A. 腭垂
B. 腭咽弓
C. 舌下阜
D. 舌下襞
E. 舌会厌正中襞

正确答案：B。腭咽弓

解析：腭咽弓(B对)为腭帆向下延至咽侧壁的黏膜皱襞。